浮小麦具有的功效是
A. 收敛止血
B. 益气止汗
C. 涩精止带
D. 涩肠敛汗
E. 止血止汗

正确答案：B。益气止汗

解析：该题考查的是浮小麦的功效，属记忆内容。浮小麦甘、凉。归心经。具有固表止汗，益气，除热的功效。（B对ACDE错）。